可能引起嗜睡、眩晕、幻觉、视物模糊或者定向力障碍等副作用，服用后不宜驾车的药物有
A. 卡马西平
B. 苯妥英钠
C. 维C银翘片
D. 地西泮
E. 氯苯那敏

正确答案：A、B、C、D、E。卡马西平；苯妥英钠；维C银翘片；地西泮；氯苯那敏

解析：本题考查驾驶员应慎用的药物。卡马西平（A对）、苯妥英钠（B对）为抗癫痫药。维C银翘片（C对）、氯苯那敏（E对）为抗过敏药。地西泮（D对）为镇静催眠药。以上药物均可引起嗜睡、眩晕、幻觉、视物模糊或者定向力障碍等副作用。